关于坏死性唾液腺化生特点的说法错误的一项是
A. 是一种病因不明、有自愈倾向的唾液腺良性疾病
B. 多见于腭部，也见于唇、颊及磨牙后腺
C. 特征为黏膜表面有深达骨面的火山口样溃疡
D. 其导管上皮腺泡样增生
E. 腺泡细胞壁溶解形成黏液池

正确答案：D。其导管上皮腺泡样增生

解析：本题考查坏死性唾液腺化生与舍格伦综合征。坏死性唾液腺化生是一种病因不明、有自愈倾向的唾液腺良性病变（A对）。本病多发于腭部，也见于唇、颊及磨牙后腺（B对）。特征为深达骨面的火山口样溃疡（C对），但不破坏骨组织。病理表现为导管上皮明显鳞状化生（D错，为本题正确答案），形成大小不等的上皮岛或上皮条索，腺泡壁溶解消失，黏液外溢形成黏液池（E对）。